男，30岁，一年前开始在公共场合用餐时，担心有人注视自己，怕自己出丑，因此不敢再动筷子吃饭，心跳加速，手抖出汗，此后，常回避公共用餐及其他人际场合，患者知道自己的害怕是不必要的，但是不能自控，最可能的诊断是
A. 躯体形式障碍
B. 精神分裂症
C. 社交焦虑障碍
D. 创伤后应激障碍
E. 强迫障碍

正确答案：E。强迫障碍

解析：躯体变形障碍患者不愿出门、不愿社交是因为认为自己的体貌变形，与社交焦虑障碍患者害怕社交不得体不同（A错）；精神分裂症社交焦虑障碍的患者害怕社交场合是因为会导致焦虑发作，精神分裂症患者回避社交是害怕被人议论、迫害，或者表现为社会性退缩，无任何社交动机（B错）；社交焦虑症是指当人们对一个或多个社交场合如公共演讲或表演，有一种强烈的恐惧感。社交焦虑障碍担心的焦点是个体的行为方式或表现出焦虑症状时会被他人做出负性评价，病程标准要求持续不少于6个月（C错）。强迫障碍（E对）有时表现为对特定物体的害怕和回避，强迫障碍的恐惧源于自己内心的些思想或观念，担心失去自我控制，并非对外界事物恐惧。创伤后应激障碍 （PTSD）（D错）是由于受到异乎寻常的威胁性、灾难性心理创伤，导致延迟出现和长期持续的精神障碍。